有关脾的描述，错误的是
A. 分为前、后二端
B. 分为上、下二缘
C. 分为膈、脏二面
D. 是腹膜外位器官
E. 能贮存血液

正确答案：D。是腹膜外位器官

解析：脾可分为脏、膈两面（C对），上、下二缘（B对）和前、后二端（A对），脾具有贮存血液（E对）、造血、清除衰老红细胞和进行免疫应答的功能，脾是腹膜内位器官（D错，为本题正确答案）。